《医疗事故处理条例》规定，造成患者轻度残疾，器官组织损伤导致一般功能障碍的，属于几级医疗事故
A. —级甲等
B. —级乙等
C. 二级
D. 三级
E. 四级

正确答案：D。三级

解析：《医疗事故处理条例》总则第四条：根据对患者人身造成的损害程度，医疗事故分为四级：一级（AB错）医疗事故：造成患者死亡、重度残疾的；二级（C错）医疗事故：造成患者中度残疾、器官组织损伤导致严重功能障碍的；三级（D对）医疗事故：造成患者轻度残疾、器官组织损伤导致一般功能障碍的；四级（E错）医疗事故：造成患者明显人身损害的其他后果的。